上能敛肺气，下能滋肾阴的药物是
A. 诃子
B. 五味子
C. 乌梅
D. 五倍子
E. 覆盆子

正确答案：B。五味子

解析：五味子味酸收敛，甘温而润，能上敛肺气，下滋肾阴，为治疗久咳虚喘之要药（B对）。诃子（A错）味酸涩性收敛，入大肠经，善于涩肠止泻，为治疗久泻、久痢之常用药。乌梅（C错）味酸而涩，其性收敛，入肺经能敛肺气，治咳嗽，适用于肺虚久咳少痰；乌梅具有安蛔止痛，和胃止呕的功效，为安蛔之良药。五倍子（D错）酸涩收敛，性寒清降，入肺经主要用于肺虚久咳，肺热咳嗽；入大肠经治疗久泻久痢；入肾经涩精止遗。覆盆子（E错）甘温酸，主入肝肾经，治疗遗精滑精，遗尿尿频，阳痿早泄，肝肾不足，目暗昏花。